下列各项中，不属于惊风八候的是
A. 搐
B. 摇
C. 搦
D. 引
E. 反

正确答案：B。摇

解析：惊风根据抽搐时的主要表现可归纳为八种：搐（A对），即手臂伸缩；搦（C对），即十指开合；掣，即肩头相扑；颤，即手足动摇震颤；反（E对），即身向后反仰；引（D对），即手若开弓；窜，即两目发直；视，即眼露白睛而不灵活。摇（B错，为本题正确答案）不属于惊风八候。